非创伤性修复治疗通常采用的材料是
A. 玻璃离子
B. 复合树脂
C. 新型复合树脂
D. 银汞合金
E. 窝沟封闭剂

正确答案：A。玻璃离子

解析：本题考查玻璃离子体修复的适应证。非创伤性修复治疗通常采用的材料是玻璃离子（A对）。非创伤性修复治疗（ART）指使用手用器械去除龋损组织，然后用有粘接性、耐压和耐磨性能较好的新型玻璃离子材料充填龋洞的技术。ART具有的优点：不需电动口腔科设备、术者容易操作、患者易于接受、避免去除过多牙体组织、玻璃离子中氟离子的释放可使牙本质硬化以阻止龋的发展、兼有治疗和预防效果等。